具有喜润恶燥特性的脏腑是
A. 心
B. 肝
C. 脾
D. 胃
E. 大肠

正确答案：D。胃

解析：本题考查脏腑的生理特性，属于理解记忆内容。胃喜润恶燥，是指胃当保持充足的津液以利饮食物的受纳腐熟。胃的受纳腐熟，不仅依赖胃气的推动和蒸化，亦需胃中津液的濡润。胃中津液充足，则能维持其受纳腐熟的功能和通降下行的特性（D对）。脾喜燥恶湿（C错）。